男，29岁。喜欢吃辣，排便时肛门剧痛1周。有鲜血滴入便池，排便后肛门疼痛加重。应诊断为
A. 内痔
B. 外痔
C. 直肠癌
D. 肛瘘
E. 肛裂

正确答案：E。肛裂

解析：男，29岁。喜欢吃辣，排便时肛门剧痛1周。有鲜血滴入便池，排便后肛门疼痛加重，由排便时疼痛+间歇期+再次剧痛+便血考虑诊断为肛裂（E对）。内痔（A错）的主要临床表现是出血和脱出。外痔（B错）的主要临床表现是肛门不适、潮湿不洁。患者无直肠刺激症状，不应诊断为直肠癌（C错）。肛瘘（D错）的典型表现为瘘管外口反复排出脓性分泌物。